生活周期中有原体和网状体两种结构的微生物是
A. 立克次体
B. 衣原体
C. 支原体
D. 螺旋体
E. 丝状体

正确答案：B。衣原体